黏液囊肿常发生于
A. 下唇黏膜
B. 颊黏膜
C. 口底黏膜
D. 硬腭部黏膜
E. 软腭部黏膜

正确答案：A。下唇黏膜

解析：黏液囊肿常发生于下唇黏膜，其次为颊、口底、舌和腭部。掌握“黏液囊肿”知识点。